输血过程中，疑为溶血性反应时应采取下列的措施，除外
A. 立即停止输血
B. 静脉注射生理盐水
C. 及时报告上级医生
D. 积极抢救
E. 及时报告医院的医务科

正确答案：E。及时报告医院的医务科

解析：疑为溶血性或细菌污染性输血反应，应立即停止输血，用静脉注射生理盐水维护静脉通路，及时报告上级医师，在积极治疗抢救的同时，做以下核对检查。掌握“医疗机构临床用血管理、及法律责任”知识点。